需要做人体功效试验的是
A. 一般用途化妆品
B. 特殊用途化妆品
C. 主要用于美容的化妆品
D. 有治疗作用的化妆品
E. 用于特殊人群的化妆品

正确答案：B。特殊用途化妆品

解析：本题考查需要做人体功效试验的化妆品。特殊用途化妆品指用于育发、染发、烫发、脱毛、美乳、健美、除臭、祛斑和防晒的化妆品。这类化妆品为获得某种特殊功能，常需加入某些活性物质以便弥补体表局部缺陷而达到美化的目的。这类物质有些具有一定的副作用，因此特殊用途化妆品（B对ACDE错）需要做人体功效试验。